属于基本转录因子的是
A. 阻遏蛋白
B. TFⅡB
C. CAP
D. 乳糖
E. 结构基因

正确答案：B。TFⅡB